子宫肌瘤患者与临床症状轻重关系密切的是
A. 肌瘤大小
B. 肌瘤数目
C. 肌瘤生长部位
D. 肌瘤与肌壁关系
E. 肌瘤有无变性

正确答案：C。肌瘤生长部位

解析：子宫肌瘤患者多无明显临床症状，与症状轻重关系最密切的是肌瘤的生长部位（C对），而与肌瘤大小（A错）、数目（B错）关系不大。子宫肌瘤有无变性（E错）也与患者临床症状相关，但并不是每一例子宫肌瘤均可发生变性，因此较肌瘤生长部位相比，肌瘤有无变性和临床症状关系并非最密切。肌瘤的生长部位包含肌瘤与肌壁关系（D错）。